女性，26岁。继发闭经5年，婚后3年未孕，查体双侧泌乳，血PRL水平800μg/L，磁共振检查垂体有2.0cm的占位病变，诊断为垂体泌乳素大腺瘤，继发闭经不育。治疗宜采用
A. 手术切除垂体腺瘤
B. 放射治疗垂体腺瘤
C. 多巴胺激动剂溴隐亭
D. 人工周期恢复月经
E. 促排卵治疗不育

正确答案：C。多巴胺激动剂溴隐亭

解析：该患者诊断为垂体泌乳素大腺瘤（催乳素瘤），继发闭经不育。（八版内科学P668）治疗首选多巴胺激动剂，该类药物包括三种：溴隐亭（C对）、卡麦角林和培高利特，溴隐亭治疗后能缩小肿瘤面积，使闭经-泌乳妇女月经和生育能力得以恢复。由于药物治疗有确切疗效，仅有一小部分催乳素瘤患者需手术（A错）或放射治疗（B错），手术治疗指征包括：药物治疗时瘤体依然增大、垂体卒中、不能耐受多巴胺激动剂。多巴胺激动剂抵抗等。人工周期恢复月经（P358）（D错）、促排卵治疗不育（P358）（E错）只用于治疗闭经，不适用于催乳素瘤的治疗。